治疗湿浊蒙蔽清窍所致的神志昏乱，健忘，耳鸣者，应首选
A. 磁石
B. 竹茹
C. 冰片
D. 牛黄
E. 石菖蒲

正确答案：E。石菖蒲

解析：湿浊蒙蔽清窍所致的神志昏乱，治以开窍醒神，健忘，耳鸣者，治以开心窍、益心智、安心神、聪耳明目。石菖蒲新开苦燥温通，芳香走窜，不但有开窍醒神之功，且兼有化湿，豁痰，辟秽之效，擅长治疗痰湿秽浊之邪蒙蔽清窍所致神志昏乱，并且石菖蒲入心经，开心窍、益心智、安心神、聪耳明目，可治健忘，耳鸣（E对）。磁石具有镇惊安神，平肝潜阳，聪耳明目，纳气平喘的功效，能镇惊安神，治肾虚耳鸣、耳聋,没有开窍醒神之功，不能治疗湿浊蒙蔽清窍所致的神志昏乱（A错）。竹茹具有清热化痰，除烦止呕的功效，没有开窍醒神，宁神益智的功效（B错）。冰片具有开窍醒神，清热止痛的功效，没有宁神益智的功效，冰片性偏寒凉，为凉开之品，更宜用于热闭神昏,不能治疗健忘，耳鸣（C错）。牛黄具有化痰开窍，凉肝息风，清热解毒的功效，牛黄性凉，其气芳香，能清心，去痰，开窍醒神，用治温热病热入心包证（D错）。